男，82岁，有多年冠心病病史。夜间睡觉时突发胸闷，端坐呼吸，查体：R35次/分，BP80/50mmHg，双肺可闻及湿啰音，心率102次/分。接下来该患者首选检查是
A. X线胸片
B. 24小时动态心电图
C. 心肌核素扫描
D. 超声心动图
E. 心肌灌注

正确答案：D。超声心动图

解析：患者男，82岁，既往有多年冠心病病史，在夜间睡觉时突然出现胸闷、端坐呼吸、低血压、心率快，听诊可闻及双肺的湿啰音（急性左心衰的表现和体征），故结合患者的病史、表现、查体，应首选超声心动图（D对）。X线不能看出患者心肌缺血损伤情况（A错），24小时动态心电图（B错）、核素扫描（C错）以及心肌灌注（E错）对于急性左心衰病人来说太慢，对于诊断帮助较小。